下列不按五行相生顺序排列的是
A. 呼、笑、歌、哭、呻
B. 筋、脉、肉、皮毛、骨
C. 青、赤、黄、白、黑
D. 角、徵、商、宫、羽
E. 酸、苦、甘、辛、咸

正确答案：D。角、徵、商、宫、羽

解析：本题考查事物属性的五行归类，属于记忆内容。五音的五行相生顺序排列是角、徵、宫、商、羽（D错，为本题正确答案）。五声的五行相生顺序排列呼、笑、歌、哭、呻（A对）。形体的五行相生顺序排列是筋、脉、肉、皮毛、骨（B对）。五色的五行相生顺序排列是青、赤、黄、白、黑（C对）。五味的五行相生顺序排列是酸、苦、甘、辛、咸（E对）。